某地新生儿出生身高55.1cm，标准差2.2，6岁儿童身高119.5cm，标准差4.3，比较离散趋势应用
A. 标准差
B. 变异指数
C. 四分位数间距
D. 极差
E. 离均差平方和

正确答案：B。变异指数

解析：某地新生儿出生身高55.1cm，标准差2.2，6岁儿童身高119.5cm，标准差4.3，结合这种表现，离散趋势应用变异系数（B对）。（P15）方差是用取平方后的单位来表示的，如果血压的原始数据用毫米汞柱表示，则方差就是毫米汞柱的平方（A错）。（P15）四分位数间距的特点是它不像极差容易受到极端值的影响，但仍未用每一个具体的观测值，主要用于描述明显偏态分布资料的变异特征，并常常结合统计图应用（C错）。（P15）极差主要关注的是一组数据的整个变化范围…如用于说明传染病、食物中毒等的最短、最长潜伏期等（D错）。（P15）可以通过取平方来避免正负抵消，即使用方差衡量数据的变异程度，其计算公式为S2＝∑（X-X）2/n-1，其中∑（X-X）2称为离均差平方和（E错）。